下列做法不能实现健康治理目标的是
A. 强有力的政治领导
B. 按固定的政策解决人们的利益冲突
C. 持久的政治承诺
D. 明确公民、社会有效参与的途径和方式
E. 促使不同政策领域之间达成健康共识

正确答案：B。按固定的政策解决人们的利益冲突

解析：本题考查实现健康治理目标的要求。实现健康治理目标需要强有力的政治领导（A对）和持久的政治承诺（C对），需要明确公民、社会有效参与的途径和方式（D对），鼓励人们通过不断的政策、制度、组织、机制创新来解决人们的利益冲突（B错，为本题正确答案），并促使不同政策领域之间达成健康共识（E对）。